男，60岁。诊断为重症肌无力。治疗过程中出现呼吸困难、多汗、流涎、瞳孔缩小，可能的原因是
A. 胆碱能系统亢进
B. 肾上腺素能系统抑制
C. 胆碱能系统抑制
D. 肾上腺素能系统亢进
E. 5-HT系统亢进

正确答案：A。胆碱能系统亢进

解析：重症肌无力是一种神经-肌肉传递功能障碍的获得性自身免疫性疾病，主要由于神经-肌肉接头突触后膜上AChR受损引起（P365），临床上应用胆碱酯酶抑制剂通过抑制胆碱酯酶，减少ACh的水解，改善神经-肌肉接头间的传递，增加肌力。本例患者老年男性，已确诊为重症肌无力，治疗过程中出现呼吸困难、多汗、流涎、瞳孔缩小等毒蕈碱样反应，为胆碱能系统亢进（A对C错）表现。肾上腺素能系统（BD错）和5-HT系统（E错）与重症肌无力的发病和治疗无关。